主含木脂类成分，来源于木犀科的中药是
A. 知母
B. 前胡
C. 厚朴
D. 细辛
E. 连翘

正确答案：E。连翘

解析：本题考查的是含木脂素类化合物的常用中药。主含木脂类成分，来源于木犀科的中药是连翘（E对）。连翘系木犀科植物连翘的干燥果实。连翘中的木脂素类成分多为双环氧木脂素及木脂内酯，《中国药典》以挥发油、连翘苷和连翘酯苷A为指标成分进行含量测定，要求青翘的挥发油含量不得少于2.0%（ml/g），青翘的连翘酯苷A含量不得少于3.5%，老翘含连翘酯苷A不得少于0.25%；对连翘苷含量要求不得少于0.15%。知母（A错）中的化学成分主要为甾体皂苷和芒果苷，还含有木脂素、甾醇、鞣质、胆碱等成分。《中国药典》上将知母皂苷BⅡ和芒果苷定为知母药材的质量控制成分，要求知母皂苷BⅡ含量不得少于3.0%，芒果苷的含量不得少于0.7%。前胡（B错）主要化学成分为多种类型的香豆素及其糖苷、三萜糖苷及甾体糖苷、挥发油等。一般以香豆素类成分作为前胡定量质量控制的指标。《中国药典》采用高效液相色谱法测定药材中白花前胡甲素和白花前胡乙素含量，其中白花前胡甲素含量不少于0.90%，白花前胡乙素不少于0.24%。厚朴（C错）中主要化学成分为木脂素类化合物，包括厚朴酚以及和厚朴酚等，《中国药典》采用高效液相色谱法测定药材中厚朴酚与和厚朴酚含量，两者总含量不得少于2.0%。辽细辛（D错）的主要化学成分为挥发油、木脂素类和黄酮类等。挥发油约占其含量的3%。《中国药典》以细辛脂素为指标成分进行含量测定，含量不得少于0.050%。同时规定挥发油不得少于2.0%（ml/g）。细辛含有痕量的马兜铃酸Ⅰ，有肝肾毒性。《中国药典》对马兜铃酸Ⅰ进行限量检查，要求其含量不得过0.001%。